小蓟具有的功效是
A. 解毒消痈
B. 收湿敛疮
C. 消肿排脓
D. 化腐生肌
E. 化腐生肌

正确答案：A。解毒消痈

解析：小蓟的功效是凉血止血，散瘀解毒消痈（A对）。炉甘石的功效是解毒明目退翳，收湿止痒敛疮（B错）。白芷的功效是解表散寒，祛风止痛，消肿排脓（C错），燥湿止带，通鼻窍。铅丹的功效是拔毒化腐生肌（D错），杀虫止痒。明矾的功效是外用解毒杀虫，燥湿止痒（E错）；内服止血，止泻，化痰。